手足口属于法定报告类传染病中的
A. 甲类
B. 乙类
C. 丙类
D. A类
E. B类

正确答案：C。丙类

解析：本题考查丙类传染病。丙类（C对ABDE错）传染病共有11种：流行性感冒（含甲型HlNl流感）、流行性腮腺炎、风疹、急性出血性结膜炎、麻风病、流行性和地方性斑疹伤寒、黑热病、包虫病、丝虫病，除霍乱、细菌性和阿米巴性痢疾、伤寒和副伤寒以外的感染性腹泻病、手足口病。